正常分娩率
A. 妊娠雌性动物数与交配雌性动物数之比
B. 正常分娩雌性动物数与妊娠动物数之比
C. 出生后4天存活幼仔数与分娩时出生幼仔数之比
D. 21天断奶幼仔存活数与出生后4天幼仔存活数之比
E. 正常分娩雌性动物数与交配雌性动物数之比

正确答案：B。正常分娩雌性动物数与妊娠动物数之比